患者，35岁，左上6远中邻面深龋进行治疗，去龋未尽穿髓，穿髓孔一钻针大小，则该患牙应如何处理
A. 氢氧化钙制剂直接盖髓，ZOE安抚观察2周
B. 氢氧化钙制剂直接盖髓观察3个月，后视情况处理
C. 活髓切断术
D. 根管治疗
E. 干髓术

正确答案：D。根管治疗

解析：本题考查慢性牙髓炎的治疗。深龋未去净腐质露髓诊断为慢性牙髓炎，治疗方法为根管治疗（D对）。由于患者35岁，牙齿根尖已经发育完全，所以不需进行直接盖髓术（AB错）和活髓切断术（C错）来促进牙根继续发育。干髓术（E错）需在严格无菌的条件下进行，且治疗不彻底容易继发疼痛，现很少用。